对疮疡破溃处皮肤消毒，涂擦消毒剂的顺序是
A. 由伤口的中心部向四周涂擦
B. 由伤口的外周涂向伤口部
C. 由伤口的上方涂向下方
D. 由伤口的一侧涂向另一侧
E. 无需按一定顺序

正确答案：B。由伤口的外周涂向伤口部

解析：手术区皮肤消毒，一般用消毒液由手术区中心部向四周涂擦进行皮肤消毒三遍。如为感染性伤口、肛门部、结肠造瘘口等部位，则应自手术区域外周向切口部涂擦。本题疮疡破溃处伤口属感染性伤口，故消毒应由伤口的外周涂向伤口部（B对）。